牙拔除过程中最常使用的力为
A. 扭转力
B. 摇动力
C. 杠杆力
D. 楔力
E. 轮轴力

正确答案：B。摇动力

解析：本题考查拔牙的基本步骤-患牙脱位的运动力。牙拔除过程中最常使用的力为摇动力（B对）。摇动力是牙拔除过程中最常使用的力，通过缓慢反复的摇动利用牙槽骨的弹性和让性，将牙槽窝逐渐扩大，并撕裂牙周膜，各种牙都可使用。扭转力（A错）只适用于圆锥形单根牙，如上颌中切牙和尖牙；若多根牙、扁根牙、弯根牙使用扭转力，会导致断根。牙拔除过程中主要有三种力：摇动力、扭转力、牵引力；杠杆力（C错）、楔力（D错）、轮轴力（E错）是牙挺使用时利用的三种力，不属于同一个范畴。